随着环境有害因素的剂量增加，产生某种生物学效应的个体数随之增加，通常以出现特定生物效应的个体数占总测定个体数的百分数来表示，这种关系是
A. 因果关系
B. 剂量-效应关系
C. 剂量-反应关系
D. 对立统一关系
E. 相互作用关系

正确答案：C。剂量-反应关系

解析：本题考查剂量-反应关系。随着环境有害因素的剂量增加，产生某种生物学效应的个体数随之增加，通常以出现特定生物效应的个体数占总测定个体数的百分数来表示，这种关系是剂量-反应关系（C对ABDE错）。